一患者主诉左下后牙食物嵌塞，临床：左下78间食物嵌塞，左下8正位且无对颌牙，请分析引起食物嵌塞最可能的原因是
A. 外溢道消失
B. 对颌牙尖过于高陡
C. 两牙边缘嵴高度不一致
D. 上颌牙下垂
E. 牙间乳头退缩

正确答案：C。两牙边缘嵴高度不一致

解析：本题考查食物嵌塞的原因。该患者左下8正位且无对颌牙，则左下8会伸长，会使左下78边缘嵴高度不一致（C对），在咬合时来自对颌牙的力可将食物楔入这两牙之间，这是最可能的原因。外溢道消失（A错）、对颌牙尖过于高陡（B错）、上颌牙下垂（D错）、牙间乳头退缩（E错）也会造成食物嵌塞，但临床检查时并未发现相应症状，都不是该患者食物嵌塞的原因。